小儿头围跟胸围相等是在
A. 1岁时
B. 2岁时
C. 3岁时
D. 4岁时
E. 5岁时

正确答案：A。1岁时

解析：新生儿头围平均34cm，胸围平均32cm，1岁时头围为46cm，胸围46cm，大致相等，以后胸围逐渐大于头围，头、胸围增长曲线形成交叉（A对）。